左心室的入口处有
A. 三尖瓣
B. 主动脉瓣
C. 二尖瓣
D. 下腔静脉瓣
E. 肺动脉瓣

正确答案：C。二尖瓣

解析：左心室的入口处有二尖瓣（C对）附着于左房室口的二尖瓣环上。